墨旱莲的功效是
A. 滋阴，润肠
B. 滋阴，软坚
C. 滋阴，清肺
D. 滋阴，止血
E. 滋阴，明目

正确答案：D。滋阴，止血

解析：本题考查墨旱莲的功效。墨旱莲的功效是滋阴，止血（D对）。墨旱莲【功效】滋阴益肾，凉血止血。玄参【功效】清热凉血，滋阴降火，解毒散结，润肠（A错）。昆布【功效】消痰软坚（B错），利水消肿。天冬【功效】滋阴降火，清肺（C错）润燥，润肠通便。石斛【功效】养胃生津，滋阴除热，明目（E错），强腰。